诊断3个月至6岁小儿营养性缺铁性贫血的标准，其血红蛋白值应低于的数值是
A. 80g/L
B. 90g/L
C. 100g/L
D. 110g/L
E. 120g/L

正确答案：D。110g/L

解析：3个月~6岁小儿营养性缺铁性贫血血红蛋白标准为90~110g/L，故其血红蛋白值应低于110g/L（D对ABCE错）。